流行病学研究方法按设计类型可分为
A. 描述性研究、分析性研究、理论性研究和预防性研究
B. 描述性研究、实验性研究、理论性研究和临床试验
C. 描述性研究、分析性研究、实验性研究和理论性研究
D. 现况研究、病例对照研究、队列研究和干预实验
E. 横断面研究、验证性病例对照研究、双向性队列研究和实验性研究

正确答案：C。描述性研究、分析性研究、实验性研究和理论性研究